患儿，女，3岁。出生时曾接种卡介苗，2岁时PPD试验5mm×6mm，最近PPD试验15mm×16mm，胸片未见异常，红细胞沉降率12mm/h。目前最适宜的处理是
A. 不需处理
B. 需用异烟肼2个月
C. 需用异烟肼3个月
D. 需用异烟肼6个月
E. 需用链霉素＋异烟肼6个月

正确答案：D。需用异烟肼6个月

解析：患儿，女，3岁。出生时曾接种卡介苗，2岁时PPD试验5mm×6mm，最近PPD试验15mm×16mm（PPD试验阳性，表明新近有结核杆菌感染），胸片未见异常，红细胞沉降率12mm/h（血沉正常）。结合患儿的病史、症状、体征，考虑患儿新近有结核杆菌感染。患儿的胸片和血沉均未见异常，但结核菌素试验由阴性转为阳性，符合预防性抗结核治疗的指征，因此对患儿进行预防性抗结核治疗，异烟肼每日10mg/kg（≤300mg/d），疗程6～9个月（D对ABC错）或异烟肼每日10mg/kg（≤300mg/d）联合利福平每日10mg/kg（≤300mg/d），疗程3个月，6岁以下儿童禁用链霉素（E错）。